眼球壁从外向内分为
A. 角膜、脉络膜和睫状体
B. 外膜、脉络膜和内膜
C. 纤维膜、血管膜和视网膜
D. 巩膜、视网膜和脉络膜
E. 球囊

正确答案：C。纤维膜、血管膜和视网膜

解析：球壁从外向内分为纤维膜、血管膜和视网膜（C对）。